病例对照研究中，对照选择的条件哪条是错误的
A. 对照应与病例来源于同一人群
B. 对照应未患所研究的疾病
C. 对照应在某些可能影响患病的因素方面与病例具有可比性的人
D. 对照除未患所研究的病以外，其他一切特征都与病例相似

正确答案：D。对照除未患所研究的病以外，其他一切特征都与病例相似

解析：本题考查病例对照研究对照的选择。病例对照研究选择对照的原则为：对照必须是以与病例相同的诊断标准确认为不患所研究疾病的人（B对）。另外，对照应该能够代表产生病例的源人群（A对），即对照的暴露分布应该与病例源人群的暴露分布一致（C对）。若对照除未患所研究的病以外，其他一切特征都与病例相似（D错，为本题正确答案），会造成匹配过度。